发生于牙槽突表面近鼻孔基部软组织内的囊肿称为
A. 鼻腭管囊肿
B. 炎性牙旁囊肿
C. 残余囊肿
D. 切牙管囊肿
E. 鼻唇（鼻牙槽）囊肿

正确答案：E。鼻唇（鼻牙槽）囊肿

解析：鼻唇（鼻牙槽）囊肿是一种发生于牙槽突表面近鼻孔基部软组织内的囊肿。掌握“鼻腭管囊肿及鼻唇囊肿”知识点。